某男，45岁。平日喜食辛辣，脾气暴躁。近日突发头晕耳鸣、咳嗽吐衄、痰多黄稠、咽膈不利、口渴心烦，证属肝火犯肺，宣选用的成药是
A. 导赤丸
B. 芩连片
C. 黛蛤散
D. 西黄丸
E. 新雪颗粒

正确答案：C。黛蛤散

解析：本题考查的是黛蛤散的主治。平日喜食辛辣，脾气暴躁。近日突发头晕耳鸣、咳嗽吐衄、痰多黄稠、咽膈不利、口渴心烦，证属肝火犯肺，宣选用的成药是黛蛤散（C对）。黛蛤散：【主治】肝火犯肺所致的头晕耳鸣、咳嗽吐衄、痰多黄稠、咽膈不利、口渴心烦。导赤丸（A错）：【主治】火热内盛所致的口舌生疮、咽喉疼痛、心胸烦热、小便短赤、大便秘结。芩连片（B错）：【主治】脏腑蕴热，头痛目赤，口鼻生疮，热痢腹痛，湿热带下，疮疖肿痛。西黄丸（D错）：【主治】热毒壅结所致的痈疽疔毒、瘰疬、流注、癌肿。新雪颗粒（E错）：【主治】外感热病，热毒壅盛证，症见高热、烦躁；扁桃体炎、上呼吸道感染、气管炎、感冒见上述证候者。